女孩，5岁。患急性感染治疗1周，临床表现恢复正常，门诊医生需根据外周血象的变化作分析，该患儿白细胞分类的正常比例应约为
A. 中性粒细胞0.35、淋巴细胞0.60
B. 中性粒细胞0.50、淋巴细胞0.45
C. 中性粒细胞0.60、淋巴细胞0.35
D. 中性粒细胞0.30、淋巴细胞0.65
E. 中性粒细胞0.65、淋巴细胞0.30

正确答案：B。中性粒细胞0.50、淋巴细胞0.45

解析：患儿，5岁（属于4～6岁年龄段），中性粒细胞和淋巴细胞的比例相等（B对）。